黏液表皮样癌主要发生于
A. 腮腺
B. 腭腺
C. 唇腺
D. 舌下腺
E. 下颌下腺

正确答案：A。腮腺

解析：黏液表皮样癌患者女性多于男性，发生于腮腺者居多，其次是腭部和下颌下腺，也可发生于其他小唾液腺，特别是磨牙后腺。掌握“黏液表皮样癌”知识点。